女，50岁，对称性多关节肿痛3年，晨僵2小时，实验室检查：RF阳性，双手X线片示近端指间关节面虫蚀样改变，关节间隙狭窄。应首先考虑的诊断是
A. 反应性关节炎
B. 强直性脊柱炎
C. 类风湿关节炎
D. 骨关节炎
E. 痛风关节炎

正确答案：C。类风湿关节炎

解析：中老年女性患者，对称性多关节肿痛、晨僵（晨起明显，活动后减轻，持续时间超过1小时者意义较大），RF阳性，双手X线片示近端指间关节面虫蚀样改变，关节间隙狭窄。应首先考虑的诊断是类风湿关节炎（C对）。双手、腕关节以及其他受累关节的X线片对RA诊断、关节病变分期、病变演变的监测均很重要。早期可见关节周围软组织肿胀影、关节附近骨质疏松（I期）；进而关节间隙变窄（Ⅱ期）；关节面出现虫蚀样改变（Ⅲ期）；晚期可见关节半脱位和关节破坏后的纤维性和骨性强直（IV期）。反应性关节炎（A错）与AS均属于脊柱关节炎（是一类以累及脊柱、关节韧带和肌腱为主要表现的慢性炎症性风湿病的总称）（P825）。强直性脊柱炎（B错）首发症状常为下腰背痛伴晨僵，常见体征为骶髂关节压痛，RF阴性，90%左右的病人HLA-B27阳性（P825）。骨关节炎（C错）晨僵时间较短，一般不超过30分钟，典型X线表现为受累关节软骨下骨质硬化、囊变，关节边缘骨赘形成，受累关节间隙狭窄（P858）。